对繁殖期结核分枝杆菌有较强的抑制作用的药物是
A. 利福平
B. 异烟肼
C. 乙胺丁醇
D. 青霉素
E. 增效联磺片

正确答案：C。乙胺丁醇

解析：乙胺丁醇对繁殖期结核分枝杆菌有较强的抑制作用。掌握“异烟肼、利福平及乙胺丁醇”知识点。